婴儿口腔保健的做法中，不正确的是
A. 喂奶应经常偏于一侧
B. 奶瓶不能紧压下颌
C. 奶瓶不能抬起过高
D. 注意喂养姿势
E. 不正确的喂养可导致下颌前突畸形

正确答案：A。喂奶应经常偏于一侧

解析：关注婴儿颌面部生长发育：注意喂养姿势，无论是母乳喂养还是人工喂养，都应采取正确的喂养姿势。喂奶经常偏于一侧，则该侧面部受压，唇、颊活动受限，长期可导致面部双侧发育不对称。人工喂养时，奶瓶不能紧压下颌，亦不能将奶瓶过高抬起，致下颌过分前伸，造成下颌前突畸形。掌握“婴幼儿的口腔保健”知识点。